脾之液为
A. 汗
B. 涕
C. 泪
D. 唾
E. 涎

正确答案：E。涎

解析：五脏与五液的关系中，汗为心之液（A错）。肺在液为涕（B错）。泪为肝之液（C错）。唾为肾之液（D错）。涎为脾之液（E对）。